根管治疗的适应证中，哪一项不确切
A. 各型牙髓炎
B. 牙髓坏死
C. 各型根尖周炎
D. 乳牙和恒牙的根尖周炎
E. 牙髓牙周联合病

正确答案：A。各型牙髓炎

解析：本题考查根管治疗的适应证。根管治疗的适应证中，各型牙髓炎（A错，为本题正确答案）不确切。牙髓炎分为可复性牙髓炎和不可复性牙髓炎。可复性牙髓炎只是牙髓充血，若能将局部病源刺激因素彻底去除，同时给予患牙适当治疗，牙髓可恢复到原有状态，无需根管治疗；不可复性牙髓炎炎症较重，只有摘除牙髓以去除病变，是根管治疗的适应症，因此各型牙髓炎是根管治疗适应症的说法是不确切的。有足够牙周支持组织且需保存患牙的病症都可进行根管治疗术，如牙髓坏死（B对）、各型根尖周炎（C对）、乳牙和恒牙的根尖周炎（D对）都是根管治疗的适应症。牙髓牙周联合病（E对）需用根管治疗来治疗牙髓病变以促进愈合。